以下选项中，对机体具有凉润宁静抑制和凝聚等作用的是
A. 肾精
B. 肾气
C. 肾阴
D. 肾阳
E. 肾血

正确答案：C。肾阴

解析：肾阴为脏腑阴液之本，宁静和抑制脏腑的各种功能，滋润全身脏腑形体官窍（C对）。肾阴充足，脏腑形体官窍得以滋润，其功能健旺而又不至于过亢，精神内守。若肾阴不足，抑制、宁静、滋润等作用减退，则致脏腑功能虚性亢奋，精神虚性躁动，发为虚热性病证。肾中精气分为肾精、肾气；肾精，即肾藏之精，来源于先天，充养于后天，是肾脏生理活动的物质基础；肾气，即肾精所化之气，是肾脏生理活动的物质基础及其动力来源。两者相互化生、相互促进，共同完成肾的生理功能（AB错）。肾阳为脏腑阳气之本，推动和激发脏腑的各种功能，温煦全身脏腑形体官窍。肾阳充盛，脏腑形体官窍得以温煦，各种功能旺盛，精神振奋。若肾阳虚衰，推动、温煦等作用减退，则脏腑功能减退，精神不振，发为虚寒性病证（D错）。肾主生髓化血，人体血液的生成，一方面是后天脾胃运化的水谷精微上输心肺而化赤为血；另一方面是肾精生髓，髓充于骨，骨中精髓为化生血液之源（E错）。